以形态命名的外科疾病是
A. 颈痈
B. 委中毒
C. 蛇头疔
D. 丹毒
E. 破伤风

正确答案：C。蛇头疔

解析：本题考查疾病的命名原则。颈痈是以部位命名的（A错）。委中毒是以穴位命名的（B错）。手足部疔疮生在指头顶端的，肿胀形如蛇头者，称为蛇头疔，以形态命名（C对）。丹毒是以颜色命名（D错）。破伤风以病因命名（E错）。